首选用于治疗疮疡阳证的外用药物是
A. 阳和油膏
B. 冲和油膏
C. 玉露油膏
D. 生肌白玉膏
E. 回阳玉龙膏

正确答案：C。玉露油膏

解析：玉露膏性偏寒凉，对焮红灼热明显、肿势散漫者效果较佳，适用于阳证疮疡（C对）。阳和油膏（A错）适用于疮疡初起脓未成。冲和油膏（B错）具有活血止痛、祛风散寒的作用，适用于半阴半阳证。生肌白玉膏（D错）润肤生肌收敛，适用于溃疡已净，疮口不敛者。回阳玉龙膏（E错）有温经散寒、活血化瘀的作用，适用于阴证。